慢性心力衰竭患者血压下降不明显是由于
A. 交感-肾上腺髓质系统兴奋
B. 肾素-血管紧张素-醛固酮系统兴奋
C. 两者均有
D. 两者均无
E. 无

正确答案：C。两者均有

解析：慢性心衰时，机体可通过兴奋交感-肾上腺髓质系统、肾素-血管紧张素-醛固酮系统（AB对，故C为本题正确答案）、增加释放抗利尿激素等使肾脏重吸收钠水增多，维持血容量稳定，使血压下降不明显。